绝大多数血浆蛋白质在肝合成，以下除外的是
A. 白蛋白
B. 纤维蛋白原
C. 纤连蛋白
D. γ-球蛋白
E. 清蛋白

正确答案：D。γ-球蛋白

解析：绝大多数血浆蛋白质在肝合成，如白蛋白、纤维蛋白原和纤连蛋白等。还有少量的蛋白质是由其他组织细胞合成的，如γ-球蛋白是由浆细胞合成的。掌握“血液成分及血浆蛋白”知识点。